喘证的辨证，首先应审其
A. 表里
B. 寒热
C. 虚实
D. 阴阳
E. 标本

正确答案：C。虚实

解析：喘证的发生，主要缘于肺失宣肃，而导致肺失宣肃的病因则有外感、内伤之别，无论邪从外袭还是病从内伤，引起的病理变化均可概括为虚实两个方面。正如《景岳全书·喘促》篇说：“实喘者有邪，邪气实也；虚喘者无邪，元气虚也。”故历代喘证的辨证，均首当审其虚实（C对）。表里是辨别疾病现阶段病变部位的浅深（A错）。寒证与热证的鉴别，应对疾病的全部表现进行综合观察，尤其是恶寒发热、对寒热的喜恶、口渴与否、面色的赤白、四肢的温凉、二便、舌象、脉象等，是辨别寒证与热证的重要依据（B错）。以阴阳辨病证的类别（D错）。标本主要是用来概括病变过程中矛盾的主次关系（E错）。